下列属于非牙源性囊肿的是
A. 含牙囊肿
B. 根尖周囊肿
C. 鼻牙槽囊肿
D. 牙龈囊肿
E. 萌出囊肿

正确答案：C。鼻牙槽囊肿

解析：鼻牙槽囊肿属于非牙源性囊肿，而其他属于牙源性囊肿。掌握“鼻腭管囊肿及鼻唇囊肿”知识点。